对急性肾小球肾炎诊断有意义的尿常规检查是
A. 上皮细胞管型
B. 白细胞管型
C. 颗粒管型
D. 红细胞管型
E. 脂肪管型

正确答案：D。红细胞管型

解析：对急性肾小球肾炎诊断有意义的尿常规检查是红细胞管型（D对）。急性肾小球肾炎时GBM（肾小球基底膜）断裂，红细胞通过该裂缝时受血管内压力挤压受损，受损的红细胞其后通过肾小管各段又受不同渗透压和pH作用，呈现变形红细胞血尿或红细胞管型尿，且几乎全部急性肾小球肾炎患者均有肾小球源性血尿。白细胞管型（B错）是指白细胞含量超过管型体积的1/3，主要见于肾盂肾炎、肾间质肾炎等。上皮细胞管型（A错）是指肾小管上皮细胞含量超过管型体积的1/3，主要见于各种原因导致的肾小管损伤，如缺血/再灌注、肾毒性物质等。颗粒管型（C错）为肾实质病变崩解的细胞碎片、血浆蛋白及其他有形物凝聚于T-H蛋白上而成，多见于各种肾小球疾病及肾小管的毒性损伤。有时也可出现在正常人尿中，特别是剧烈运动之后。脂肪管型（E错）内含有大量脂肪滴，常见于肾病综合征、慢性肾小球肾炎急性发作及其他肾小管损伤性疾病。